中药饮片批发企业质量管理部门负责人的资质要求是
A. 具有执业药师资格和3年以上药品经营质量管理工作经历
B. 具有大学本科以上学历，执业药师资格和3年以上药品经营质量管理工作经历
C. 具有中药学中级以上专业技术职称
D. 具有中药学初级以上专业枝术职称

正确答案：A。具有执业药师资格和3年以上药品经营质量管理工作经历

解析：本题考查药品批发企业的人员资质要求。中药饮片批发企业质量管理部门负责人的资质要求是具有执业药师资格和3年以上药品经营质量管理工作经历（A对）。药品批发企业的人员资质要求：质量负责人应当具有大学本科以上学历、执业药师资格和3年以上药品经营质量管理工作经历（B错），在质量管理工作中具备正确判断和保障实施的能力。企业质量管理部门负责人应当具有执业药师资格和3年以上药品经营质量管理工作经历，能独立解决经营过程中的质量问题。从事中药材、中药饮片验收工作的，应当具有中药学专业中专以上学历（C错）或者具有中药学中级以上专业技术职称。从事中药材、中药饮片养护工作的，应当具有中药学专业中专以上学历或者具有中药学初级以上专业技术职称（D错）；直接收购地产中药材的，验收人员应当具有中药学中级以上专业技术职称。